循证医学实践的基础不包括
A. 病人的参与
B. 病人的爱好
C. 最佳的研究证据
D. 高素质的临床医生
E. 临床流行病学的基础知识和基本方法

正确答案：B。病人的爱好